在含大量金石类药的丸剂中，起赋形与助消化作用的药是
A. 麦芽
B. 谷芽
C. 神曲
D. 莱菔子
E. 鸡内金

正确答案：C。神曲

解析：本题考查的是神曲的性能特点。在含大量金石类药的丸剂中，起赋形与助消化作用的药是神曲（C对）。神曲：【性能特点】本品甘能益中，辛温发散，焦味健胃，入脾、胃经。主消食积，兼行滞气，故能消食和胃；炒焦健胃消食力强。长于消谷食积滞，兼寒者尤宜。或云还兼发表，治外感表证兼食积者尤宜。此外，丸剂中含金石、介类药时，常以本品糊丸，以赋形、助消化。麦芽（A错）：【性能特点】本品甘益中，平不偏，芽生发，焦味健胃。主入脾、胃经，善消食健胃和中，治饮食积滞，尤宜米、面、薯、芋等食积者；兼入肝经，生用疏肝，辅治肝郁气滞及肝胃不和。此外，大量用回乳消胀，用于断乳、乳房胀痛等。谷芽（B错）：既往有些地区习惯将稻芽称为谷芽。今将谷芽定为禾本科植物粟的成熟果实经发芽干燥的炮制加工品。其味甘性微温，功效与稻芽相似，食积兼寒者用之为宜。莱菔子（D错）：【性能特点】本品辛消散，甘益中，平不偏，能升能降。入脾、胃经，善消食除胀，治食积胀满；入肺经，善降气消痰，治痰壅咳喘。习有“生升熟降”之说。鸡内金（E错）：【性能特点】本品甘益中，平不偏，消磨敛涩，药力较强。入脾、胃经，善运脾健胃、消食化积，为消食运脾之要药。入小肠、膀胱经，既化坚消石，又固精止遗，治结石、遗尿、遗精可选。